下列关于胸肺部X线检查临床应用的叙述，错误的是
A. 诊断呼吸系统疾病
B. 检测呼吸功能
C. 防癌
D. 防痨
E. 防职业病

正确答案：B。检测呼吸功能

解析：检测呼吸功能包括肺通气及肺换气功能的检查，通过物理方法来测定肺活量、残气量等参数的测定来检查肺通气及肺换气功能，肺部X线检查属于影像学检查，不能测定肺活量等，故胸肺部X线检查不能用于检测呼吸功能（B错，为本题正确答案）。胸部X线可诊断肺炎、肺脓肿等呼吸系统疾病（A对）、也可预防肺部癌症（C对）、肺结核（D对）、硅肺、尘肺等职业病（E对）的发生。